下列不属于职业卫生服务原则的是
A. 保护和预防原则
B. 全面的初级卫生保健原则
C. 适应原则
D. 健康促进原则
E. 治疗优先原则

正确答案：E。治疗优先原则

解析：治疗优先原则（E错，为本题正确答案）不是职业卫生服务原则。职业卫生服务的原则有：①保护和预防原则（A对）：②适应原则（C对）：③健康促进原则（D对）：④治疗与康复原则：⑤全面的初级卫生保健原则（B对）。